老年人使用可导致甲状腺功能异常，肺毒性或Q-T间期延长，不宜作为心房颤动一线用药的是
A. 福辛普利
B. 地高辛
C. 美托洛尔
D. 胺碘酮
E. 华法林

正确答案：D。胺碘酮

解析：本题考查药物的不良反应。胺碘酮（D错，为本题正确答案）可产生多种毒性（如甲状腺、肺）及Q-T间期延长，应避免作为房颤的一线用药。房颤患者为防止栓塞，需用抗凝血药如华法林（E对）。地高辛（B对）对具有明显症状或伴有血流动力学变化的快速房颤有效。福辛普利（A对）可作为房颤辅助用药。美托洛尔（C对）有预防房颤复发的作用。